提出“如五脏有病，或泻或补，慎勿犯胃气”的医家是
A. 钱乙
B. 刘昉
C. 曾世荣
D. 万全
E. 陈飞霞

正确答案：D。万全

解析：明代万全在朱丹溪提倡养阴的思想基础上，系统提出了 “三有余，四不足”的小儿生理病理学说。在治疗方面提出“首重保护胃气”；“五脏有病，或泄或补，慎勿犯胃气”的学说（D对）。钱乙著《小儿药证直诀》，对中医儿科学体系的形成作出了突出贡献，因而被誉为“儿科之圣”（A错）。刘昉编著《幼幼新书》40卷，许多散失的宋以前儿科著作被收录其中而得以流传，是当时世界上最完备的儿科学专著，有较高的学术及文献价值（B错）。元代名医曾世荣从医60年，编著《活幼心书》3卷、《活幼口议》20卷。详论初生诸疾，是中医新生儿学较早的集中论述，以调元散、补肾地黄丸治疗胎怯（C错）。陈飞霞是清代岭南著名儿科医生，其著作《幼幼集成》以儿科指纹学说和惊风证治为突出（E错）。